口颌系统检查中口内检查是指
A. 黏膜
B. 牙槽嵴
C. 腭穹隆的形状
D. 系带和肌肉的附着
E. 以上说法均正确

正确答案：E。以上说法均正确

解析：口颌系统检查中口内检查1）牙槽嵴；2）黏膜；3）系带和肌肉的附着；4）腭穹隆的形状；5）上下颌弓的形状和位置关系。掌握“全口义齿口腔检查及修复前准备”知识点。